人类的生物钟可能位于
A. 视交叉上核
B. 视上核
C. 室旁梳
D. 漏斗核
E. 无

正确答案：A。视交叉上核

解析：人类的生物钟可能位于下丘脑的视交叉上核（A对），此核接受来自视网膜的传入，通过下丘脑的下行通路达脊髓的交感神经低级中枢，再经交感神经颈上神经节的节后纤维随颈内动脉的分支达上丘脑的松果体，控制褪黑素的分泌，从而调节机体昼夜节律的变化。视上核（B错）、室旁核（C错）可合成分泌抗利尿激素，调节水盐代谢。漏斗核（D错）可合成分泌激素释放因子或抑制因子，经结节漏斗束投射到垂体门脉系统，调节腺垂体的内分泌功能。